关于尺神经的描述，正确的是
A. 由臂丛内侧束与外侧束合并而成
B. 绕肱骨外侧髁内的尺神经沟下行
C. 在前臂发支到尺侧腕屈肌和指浅屈肌尺侧半
D. 穿过腕管进入手掌部
E. 分支支配拇收肌

正确答案：E。分支支配拇收肌

解析：尺神经由臂丛内侧束发出（A错），穿内侧肌间隔至臂后区内侧，下行进入肱骨内上髁后方的尺神经沟（B错），主干在豌豆骨桡侧，屈肌支持带浅面分为浅支和深支，在掌腱膜深面、腕管浅面进入手掌（D错）。尺神经在臂部不发任何分支，在前臂上部发肌支支配尺侧腕屈肌和指深屈肌尺侧半（C错），其深支分布于小鱼际肌、拇收肌（E对）、骨间掌侧肌、骨间背侧肌及第3、4蚓状肌。